位于大脑外侧沟深面的是
A. 额叶
B. 颞叶
C. 枕叶
D. 岛叶
E. 无

正确答案：D。岛叶

解析：位于大脑外侧沟深面的是岛叶（D对）；额叶（A错）为外侧沟上方和中央沟以前的部分；颞叶（B错）为外侧沟以下的部分；枕叶（C错）位于大脑半球后部，在内侧面为顶枕沟以后的部分。